不属于干槽症临床表现的是
A. 可分为腐败型与非腐败型
B. 持续性疼痛，可向耳颞部放射
C. 拔牙窝空虚
D. 腐败型较为严重而多见
E. 骨壁触痛不明显

正确答案：E。骨壁触痛不明显

解析：干槽症临床上可分为腐败型与非腐败型两类，前者更严重而多见。主要症状发生在术后3～4天后的持续性疼痛，可向耳颞部放射。检查时，腐败型者可见拔牙窝空虚，牙槽骨壁表面有灰白色假膜覆盖，创内有腐败坏死物质，有明显臭味；骨壁有明显触痛，创口周围牙龈略红肿；局部淋巴结可有肿大，压痛。偶有发生张口受限、低热、全身不适等症状。掌握“牙拔除术并发症”知识点。